对未经治疗的患者，以下检查项目，哪项结果正常时最有助于排除心力衰竭
A. 心电图
B. 胸部X线检查
C. 冠状动脉造影
D. 血浆利钠肽水平
E. 血浆肌钙蛋白水平

正确答案：D。血浆利钠肽水平

解析：人类有三种利钠肽类（P165-P166），其中心钠肽（ANP）主要由心房分泌，其生理作用是扩张血管和利尿排钠，对抗肾上腺素、肾素-血管紧张素和AVP系统的水钠潴留效应；脑钠肽（BNP）主要由心室肌细胞分泌，生理作用与ANP相似但较弱；C型利钠肽（CNP）生理作用尚不明确。心力衰竭时，心室壁张力增加，BNP及ANP分泌明显增加，其增高的程度与心衰的严重程度呈正相关，可作为评定心衰进程和判断预后的指标。未经治疗者若血浆利钠肽水平正常（D对）可基本排除心衰诊断。心电图（A错）主要用于心律失常和冠心病的辅助检查，对心力衰竭诊断意义不大。胸部X线检查（P168）（B错）是确诊左心衰竭肺水肿的主要依据，但并非所有心衰患者均存在心影增大。冠状动脉造影（P222）（C错）为有创性检查手段，目前仍然是诊断冠心病较准确的方法，与心力衰竭的诊断无关。严重心衰或心衰失代偿期、败血症等情况下，血浆肌钙蛋白水平轻度升高（E错），不能用于排除心衰，主要用于明确是否存在心肌坏死。